红外线对眼睛的损伤不包括
A. 角膜的热损伤
B. 热性白内障
C. 急性角膜结膜炎
D. 慢性充血性睑缘炎
E. 视网膜灼伤

正确答案：C。急性角膜结膜炎

解析：本题考查红外线对眼睛的损害。红外线对眼睛的损害主要表现在，长期暴露于低能量红外线下，可致眼的慢性损伤，常见为慢性充血性睑缘炎（D对）、角膜虹膜损伤、白内障和视网膜损伤（BE对）。短波红外线能被角膜吸收产生角膜的热损伤（A对），并能透过角膜伤及虹膜，而白内障多见于工龄长的工人。早期，病人除自觉视力逐渐减退外，无其他主诉。最终导致晶状体全部浑浊，与老年性白内障相似。上述改变一般两眼同时发生，但进展缓慢。红外线不会引起急性角膜结膜炎（C错，为本题正确答案）。